酸碱滴定法中所用的指示液是
A. 结晶紫
B. 碘化钾-淀粉
C. 荧光黄
D. 酚酞
E. 邻二氮菲

正确答案：D。酚酞

解析：本题考查酸碱滴定法。酸碱滴定法是利用酸和碱在水中以质子转移反应为基础的滴定分析方法，其酸碱指示剂包括甲基橙、酚酞（D对）、甲基红等。结晶紫（A错）是非水碱量法的指示剂。碘化钾-淀粉（B错）是碘量法的指示剂。荧光黄（C错）是溶液沉淀法的指示剂。邻二氮菲（E错）是铈量法的指示剂。